下列关于喉上神经的叙述中，正确的是
A. 发自迷走神经
B. 向前下分为内、外侧两支
C. 分别布于喉和环甲肌
D. 斜行于颈内、外动脉的深面
E. 以上都正确

正确答案：E。以上都正确

解析：喉上神经：发自迷走神经，向前下分为内、外侧两支，斜行于颈内、外动脉的深面，分别布于喉和环甲肌。掌握“气管颈段、颈动脉三角的解剖特点及临床应用”知识点。